女，29岁，体健。主诉：近3个月刷牙牙龈易出血，且咀嚼较硬食物时牙龈出血。若此患者诊断为妊娠期龈炎，临床检查最可能的发现是
A. 牙龈乳头变平
B. 牙龈疼痛，出血，有恶臭味
C. 牙龈出血及牙齿松动
D. 牙龈增生肥大，覆盖至牙面的2／3
E. 龈缘及乳头鲜红色，松软发亮

正确答案：E。龈缘及乳头鲜红色，松软发亮

解析：本题考查妊娠期龈炎的临床表现。妊娠期龈炎可发生于个别牙龈和全口的牙龈，以前牙区为重，龈缘和龈乳头呈鲜红或暗红色，松软而光亮（E对）。牙龈乳头变平（A错）和牙龈疼痛，出血，有恶臭味（B错）主要见于急性坏死性溃疡性龈炎，龈乳头被破坏后与龈缘成一直线，如刀切状，由于有组织的坏死，患者常有特殊的腐败性恶臭，妊娠期龈炎无此表现。牙龈出血及牙齿松动（C错）主要见于牙周炎的情况，妊娠期龈炎一般不会导致牙齿松动。牙龈增生肥大，覆盖至牙面的2/3（D错）主要见于牙龈纤维瘤病，妊娠期龈炎的牙龈增生肥大主要表现为一个或多个牙龈乳头呈瘤样肥大。